千锤丹属于
A. 粉剂
B. 膏药
C. 洗剂
D. 溶液
E. 软膏

正确答案：B。膏药

解析：千锤膏是膏药的一种，可用于红肿热痛明显之阳证疮疡（B对）。粉剂有阳毒内消散、红灵丹、阴毒内消散、桂麝散、黑退消、九一丹、八二丹、白降丹、枯痔散等（A错）。洗剂有三黄洗剂等（C错）。软膏有金黄膏、玉露膏等（E错）。